下列可引起头痛伴剧烈眩晕是
A. 偏头痛
B. 中暑
C. 颅内高血压
D. 小脑肿瘤
E. 蛛网膜下腔出血

正确答案：D。小脑肿瘤

解析：肿瘤首先会压迫小脑导致出现小脑的功能受损，导致出现眩晕的症状。其次还会引起后颅窝的压力增高，从而导致出现疼痛的症状，主要是表现为后枕位置的胀痛（D对）；偏头痛是临床常见的原发性头痛，属于慢性神经血管性疾病。其特征是反复发作性、多为偏侧、中重度、搏动样头痛，一般持续4～72小时（A错）；中暑是在高温、高湿及通风不良环境中发生的机体受热过度的急性综合征，主要表现为头晕、头痛、口渴、多汗、疲乏、心悸、发热、脉搏加快等（B错）；颅内高血压的三大主症为头痛、呕吐、视乳头水肿。严重者还可能出现意识不清、呼吸循环衰竭，还可导致脑疝危及生命（C错）；蛛网膜下腔出血是脑部血管破裂，血液流入蛛网膜下隙引起的一种疾病，症状有头痛、呕吐、意识障碍、精神异常、颈部僵硬等（E错）。